男性，30岁，近5年腹泻，多次细菌培养阴性，结肠镜检查见直肠乙状结肠黏膜血管纹理模糊，黏膜细颗粒状，HB110g/L，下面哪项治疗是适当的
A. 禁食
B. 静脉高营养
C. 输血
D. 肾上腺糖皮质激素
E. 水杨酸制剂

正确答案：E。水杨酸制剂

解析：男性，30岁，近5年腹泻，多次细菌培养阴性（提示非感染性肠炎），结肠镜检查见直肠乙状结肠黏膜血管纹理模糊，黏膜细颗粒状（溃疡性结肠炎的典型镜下改变），HB110g/L（＜正常男性120～165g/L，提示有贫血），综上考虑诊断为溃疡性结肠炎。治疗目标是诱导并维持症状缓解以及黏膜愈合，防治并发症，改善病人生存质量，控制炎症常用水杨酸制剂（E对）。禁食应在病情严重时，并予完全胃肠外营养治疗（AB错）。肾上腺糖皮质激素用于对5-氨基水杨酸疗效不佳的中度及重度病人的首选治疗（D错）。